典型溃疡性结肠炎患者粪便的特点是
A. 稀水样便
B. 黏液便
C. 蛋花样便
D. 糊状便
E. 黏液脓血便

正确答案：E。黏液脓血便

解析：典型溃疡性结肠炎患者大便的特点是由黏膜炎性渗出、糜烂及溃疡所导致的黏液脓血便（E对）。稀水样便（A错）主要由病毒或产肠毒素性细菌引起。黏液便（B错）见于各种肠炎，并不是溃疡性结肠炎的典型表现。蛋花样便（C错）是轮状病毒引起的腹泻的特点，多见于婴幼儿。糊状便（D错）见于结核性腹膜炎（P370）以及克罗恩病（P377）。